能温肾纳气的是
A. 枳实
B. 柿蒂
C. 沉香
D. 乌药
E. 香橼

正确答案：C。沉香

解析：本题考查的是沉香的功效。能温肾纳气的是沉香（C对）。沉香：【功效】行气止痛，温中止呕，温肾纳气。枳实（A错）：【功效】破气消积，化痰除痞。柿蒂（B错）：【功效】降气止呃。乌药（D错）：【功效】行气止痛，温肾散寒。香橼（E错）：【功效】疏肝理气，和中化痰。